蒽醌类抗肿瘤药柔红霉素可引起心脏毒性，临床应用的解毒方案是
A. 在用柔红霉素后30min，使用柔红霉素2倍量的右雷佐生
B. 在用柔红霉素前30min，使用柔红霉素2倍量的氟马西尼
C. 在用柔红霉素前30min，使用柔红霉素10倍量的右雷佐生
D. 在用柔红霉素同时，使用柔红霉素等量的右雷佐生
E. 在用柔红霉素同时，使用柔红霉素等量的氟马西尼

正确答案：C。在用柔红霉素前30min，使用柔红霉素10倍量的右雷佐生

解析：本题考查蒽醌类抗肿瘤药物的解毒方案。蒽醌类抗肿瘤药柔红霉素可引起心脏毒性，临床应用的解毒方案是在用柔红霉素前30min，使用柔红霉素10倍量的右雷佐生（C对）。右雷佐生在细胞内水解成开环形式后，具有螯合作用，能与柔红霉素、多柔比星复合物螯合，抑制自由基的产生，起到保护心肌的作用，减轻由蒽醌类抗肿瘤药所引起的心脏毒性。右雷佐生以静脉滴注，剂量应为柔红霉素、多柔比星剂量的10倍，于给药前30min后再应用柔红霉素、多柔比星等抗肿瘤药。